男，25岁，突感上腹部剧痛。检查：血压130/80mmHg，脉搏110次/分，板样腹，肠鸣音消失。血红蛋白120g/L，血白细胞数8.0×10⁹/L。首先应采取的检查为
A. 腹部立位X线平片
B. 腹部B超
C. 腹腔穿刺
D. 腹部MRI
E. 腹部CT

正确答案：A。腹部立位X线平片

解析：青年男性患者，突发上腹部剧痛，板样腹，肠鸣音消失（提示腹腔空腔脏器穿孔），血压、血红蛋白正常可排除腹腔实质性脏器损伤，结合患者病史、体查和实验室检查，应考虑急性胃十二指肠溃疡穿孔。为明确诊断，首选的检查为腹部立位X线平片（A对）。溃疡穿孔后胃肠内气体进入腹腔，X线平片表现为膈下新月形阴影，若X线平片见上述影像学表现，结合病史和体查，即可确诊为急性消化性溃疡穿孔。腹部B超（B错）主要用于诊断肝、脾等实质脏器损伤，对空腔脏器的显示效果不佳。消化性溃疡穿孔早期，腹腔穿刺可为阴性，因此不作为首选检查（C错）。腹部MRI（D错）对血管损伤和某些特殊部位的血肿有较高价值，腹部CT（E错）对腹腔实质脏器损伤有重要诊断价值，两者对胃肠损伤的诊断价值不大。